判断昏迷与昏睡最有意义的检查是
A. 瞳孔对光反射
B. 角膜反射
C. 患者能否被唤醒
D. 病理反射
E. 腱反射

正确答案：C。患者能否被唤醒